男性，80岁，因脑卒中就诊，CT显示卒中部位位于脑部的基底节区，则常见的表现则是
A. 运动感觉异常
B. 快速死亡
C. 视觉异常
D. 发生言语障碍
E. 偏瘫

正确答案：E。偏瘫

解析：多数脑卒中为静态下起病，常见卒中部位若位于基底节区，则多有偏身运动障碍（偏瘫）和感觉障碍。掌握“脑卒中”知识点。